根据受伤机制，将头部受力部位对侧的脑组织损伤称为
A. 着力点伤
B. 切线伤
C. 对冲伤
D. 贯通伤
E. 传导伤

正确答案：C。对冲伤

解析：根据受伤机制，将头部受力部位对侧的脑组织损伤称为对冲伤（C对）。着力点伤（A错）是指发生在头部着力点的损伤（P184）。切线伤（B错）是指致伤物与颅骨和脑呈切线性擦过，脑内无致伤物（P195）。贯通伤（D错）是指致伤物贯通颅腔，有入口和出口（P195）。